卫生行政部门根据卫生监督量化评价的结果确定公共场所的卫生信誉度等级和日常监督频次，如公共场所信誉度等级分为B等，则
A. 每年监测1次
B. 每年监测2次
C. 每年监测3次
D. 每年监测4次
E. 每年监测5次

正确答案：B。每年监测2次

解析：本题考查公共场所信誉度等级为B等的日常监督频次。卫生行政部门根据卫生监督量化评价的结果确定公共场所的卫生信誉度等级和日常监督频次。信誉度等级分为A、B、C、D四等，A等每年监测1次；B等每年监测2次（B对ACDE错）；C等每年监测3次；D等属于不符合卫生要求的公共场所，应限期改进或停业整顿。